伦理委员会审查的内容不包括
A. 心理学研究项目
B. 受试者的知情同意
C. 医学新技术研究项目
D. 受试者的个人隐私
E. 对生物学研究项目进行伦理审查检查和监督

正确答案：D。受试者的个人隐私

解析：伦理委员会审查的内容有：①凡牵涉到收集人的标本、血液以及医学生物信息的医学新技术研究项目（C对）；②通过生物医学研究形成的医疗卫生技术在人体上进行实验性应用的活动；③以人为研究对象的药品临床实验等科研项目、方案和新仪器设备；④受试者的知情同意（B对）；⑤临床研究过程中所出现的严重不良事件；⑥心理学研究项目（A对）；⑦对生物学研究项目进行伦理审查检查和监督（E对）。受试者的个人隐私（D错，为本题正确答案）不受伦理委员会审查。